导致慢性支气管炎发生、发展、反复发作的重要因素是
A. 长期吸烟
B. 感染因素
C. 理化刺激
D. 寒冷气候
E. 过敏因素

正确答案：B。感染因素

解析：慢性支气管炎致病原因比较复杂，往往是多种因素长期相互作用的结果，如遗传因素、长期吸烟（A错）、理化刺激（C错）、寒冷气候（D错）、过敏因素（E错）、自主神经功能失调等，但呼吸道感染（B对）是慢性支气管炎发病与急性发作的重要原因，以病毒居多。